用药后能消除原发致病因素，产生对因治疗作用的药物是
A. 抗高血压药
B. 解热药
C. 抗惊厥药
D. 抗菌药
E. 镇痛药

正确答案：D。抗菌药

解析：本题考查药物的治疗作用。药物的治疗作用是指患者用药后所产生的符合用药目的达到防治疾病的作用。根据药物所达到的治疗效果，可将治疗作用分为对因治疗、对症治疗和补充（替代）治疗。对因治疗指用药后能消除原发致病因子，治愈疾病的药物治疗。例如使用抗生素（D对）杀灭病原微生物从而控制感染性疾病。